既杀虫，又疗癣的药是
A. 苦楝皮
B. 香加皮
C. 地骨皮
D. 桑白皮
E. 合欢皮

正确答案：A。苦楝皮